男，1岁。突然哭闹4小时，阵发性发作，不发作时如正常，发作时面色苍白伴呕吐，为所食牛奶，大便呈果酱样。常规首选的治疗方法是
A. 急症剖腹探查
B. 低压空气灌肠
C. 静脉滴注抗生素
D. 胃肠减压
E. 镇静和止痛药物

正确答案：B。低压空气灌肠

解析：患儿有果酱便、哭闹、呕吐的临床表现，应诊断为肠套叠，由题干可知患儿发病4小时（在24小时之内）、全身状况好，常规首选的治疗方法是：低压空气灌肠（B对）。当肠套叠严重，引起肠绞榨时才需要急症剖腹探查（A错）。肠套叠的实质并不是感染引起的，所以静脉滴注抗生素的对肠套叠的作用不大（C错）。胃肠减压仅仅可以缓解肠套叠的腹胀等表现，属于一般治疗不是首选治疗方法（D错）。镇静和止痛药物会掩盖病情的发展，导致治疗不及时发展为肠坏死，属禁用药（E错）。